从寿命损失率指标分析，对人类寿命影响较大的疾病因素是
A. 心血管疾病
B. 脑血管疾病
C. 恶性肿瘤
D. 车祸
E. 自杀

正确答案：D。车祸